患者，男，66岁，BMI31.2kg/m²，体检时发现血糖异常前来就诊，空腹血糖8.2mmol/L，餐后2小时血糖12.2mmolL，糖化血红蛋白8.0%。患者既往有磺胺类药物过敏史。医师处方二甲双胍片，每次1000mg，每日2次；西格列汀片，每次100mg，每日1次。关于西格列汀的作用特点和临床应用注意事项的说法，正确的是
A. 不宜用于胰岛素促泌剂治疗后的血糖不达标者
B. 宜单独使用，不宜联用其他降糖药
C. 中效、稳定地降低糖化血红蛋白水平0.8%～1%
D. 有显著的降低体重作用
E. 刺激胰岛素分泌，具有血糖依赖性，易发生低血糖反应

正确答案：C。中效、稳定地降低糖化血红蛋白水平0.8%～1%

解析：本题考查西格列汀的作用特点和临床应用注意事项。西格列汀为DPP-4抑制剂，作用强度中等，具有下列特点：（1）可中效、稳定地降低糖化血红蛋白，其可降低HbAlc水平0.8%～1%（C对），尤其对临床应用双胍、磺酰脲类促胰岛素分泌药治疗后的空腹、餐后血糖下降不明显者（A错），可有效降低血糖和糖化血红蛋白。（2）在联合用药上更加随机、方便，既可单药治疗亦可联合应用，能与双胍类、磺酰脲类、非磺酰脲类、噻唑烷二酮类、胰岛素类药（B错）任意搭配。（3）刺激胰岛素分泌具有血糖依赖性，发生低血糖反应较少（E错），对体重、血压几乎无影响（D错）。